不属于患者道德的权利的是
A. 根据病情获得休息和免除一定社会义务
B. 医疗保障权
C. 医疗服务的选择权
D. 疾病的认知权
E. 对医疗机构及其医务人员进行监督

正确答案：E。对医疗机构及其医务人员进行监督

解析：患者道德的权利的是；①根据病情获得休息和免除一定社会义务（A对）；②医疗保障权（B对），受尊重和保护权；③医疗服务的选择权（C对）；④疾病的认知权（D对）；⑤生命权、健康权、平等的医疗保健权；⑥知情同意权；⑦保守个人医密和隐私权；⑧参与权；⑨医疗诉讼权；⑩医疗索赔权等权利。患者有对医疗过程监督的权利，而不是对医疗机构及其医务人员进行监督（E错，为本题正确答案）的权利。